以下不属于盖髓剂的是
A. 氧化锌丁香油酚粘固剂
B. 氢氧化钙制剂
C. 抗生素+激素
D. 玻璃离子水门汀
E. Dycal

正确答案：D。玻璃离子水门汀

解析：本题考查盖髓剂。玻璃离子水门汀（D错，为本题的正确答案）主要用于牙缺损的充填修复、固定修复体及正畸附件的粘固、窝洞的垫底及衬洞，具有一定的牙髓刺激性不用于盖髓剂。盖髓剂是盖髓术中用于覆盖牙髓暴露处，保存牙髓活力的药物。能够促进牙髓组织修复再生，有较强的杀菌或抑菌作用等。许多药物和材料可作为盖髓剂用于盖髓治疗，包括防腐剂、抗炎剂、抗生素+激素（C对）等生物材料，其中氢氧化钙制剂（B对）和MTA是最具有疗效的盖髓剂。Dycal（E对）是氢氧化钙的制剂，用于盖髓治疗有利于消除炎症和减轻疼痛。氧化锌丁香油酚粘固剂（A对）对牙髓的刺激性极小，有止痛、安抚和轻度的防腐作用，能促进修复性牙本质的形成，可用作盖髓剂。